屈肘并使前臂旋后的肌
A. 旋前圆肌
B. 指伸肌
C. 指深屈肌
D. 肱二头肌
E. 旋后肌

正确答案：D。肱二头肌

解析：旋前圆肌（A错）使前臂旋前，屈肘。指伸肌（B错）伸第2～5指和伸腕。指深屈肌（C错）屈第2～5指指骨间关节和掌指关节，屈腕。肱二头肌（D对）屈肘关节，使前臂旋后，协助屈肩关节。旋后肌（E错）使前臂旋后。